女，40岁。突发上腹痛、恶心8小时。疼痛由局部逐渐波及全腹，伴发热。既往十二指肠溃疡病史20年。查体：T38.4℃，P104次／分，R26次/分，BP110/70mmHg。肺呼吸音清，未闻及干湿性啰音，心律齐。全腹肌紧张，压痛和反跳痛阳性，肠鸣音消失。对这种疾病的描述中错误的是
A. 保守治疗无效后需剖腹探查
B. 若诊断和治疗延误易致中毒性休克
C. 常常伴有代谢性碱中毒
D. 继发性腹膜炎较原发性腹膜炎多见
E. 大多数合并麻痹性肠性肠梗阻

正确答案：C。常常伴有代谢性碱中毒

解析：该患者既往十二指肠溃疡病史20年（空腔脏器穿孔是继发性腹膜炎最常见的原因）。突发上腹痛，疼痛有局部逐渐波及全腹，伴恶心，发热，查体P104次/分（正常60～100次/分）（腹膜炎典型临床表现）。全腹肌紧张，压痛和反跳痛阳性（腹膜刺激征：腹膜炎典型体征）。综合该患者病史、查体及临床表现，该患者诊断考虑为继发性腹膜炎。继发性化脓性腹膜炎是最常见的腹膜炎（D对）。麻痹性肠梗阻多发生在腹腔手术后、腹部创伤或弥漫性腹膜炎病人（E对），毒素刺激以致肠壁肌运动紊乱，使肠蠕动丧失。经保守治疗6～8小时后腹膜炎症状体征不缓解反而加重者需手术治疗（A对）。若诊断或治疗延误，大量细菌毒素入血，易导致中毒性休克（B对）。急性化脓性腹膜炎患者常合并代谢性酸中毒（C错，为本题正确答案）。